某县有人口10万人，1997年因各种疾病死亡1000人。该年共发生结核300人，原有结核400人，1997年共有60人死于结核，请问：结核的发病率为
A. 300/10万
B. 400/10万
C. 700/10万
D. 300/1000
E. 400/1000

正确答案：A。300/10万

解析：本题考查发病率的计算。发病率是指一定期间内，一定范围人群中某病新发生病例出现的频率。计算时分子为一定时期内某人群中某病的新发病例，旧病例不算在其中，分母为同期该人群的暴露人口数。当分子分母相差大于1000倍时，可不考虑被暴露人口，因此发病率为300/10万（A对BCDE错）。